女，22岁，因服吲哚美辛数片后觉上腹痛，今晨呕咖啡样胃内容物400ml来诊。既往无胃病史。首选的检查是
A. 血清胃泌素测定
B. B型超声检查
C. X线胃肠钡餐检查
D. 急诊胃镜检查
E. 胃液分析

正确答案：D。急诊胃镜检查

解析：青年女性患者，既往无胃病史，服用吲哚美辛（吲哚美辛为非甾体抗炎药，服用非甾体抗炎药为急性胃炎的常见病因）后胃痛、并呕咖啡样胃内容物400ml（胃痛、呕血为重症急性胃炎的表现）。根据患者的病史、临床表现，考虑诊断为急性胃炎。由于胃粘膜修复很快，当临床提示急性胃炎时，应首选急诊胃镜检查（D对）。血清胃泌素测定（A错）和胃液分析（E错）主要用于胃泌素瘤的诊断（八年制第2版内科学P440）。B型超声检查（B错）对被气体遮盖的组织探查受限，显影不佳，故对胃部疾病的诊断准确性不高。X线胃肠钡餐（C错）对胃肠道的显影效果不如胃镜，主要用于不愿接受胃镜检查者或没有胃镜时。